某人误食某种物质1小时候后，出现头晕、头痛、恶心、呕吐、多汗、胸闷、视力模糊、无力、肌震颤、瞳孔缩小、呼吸困难、意识模糊、呼出气体有大蒜样恶臭，该人可能是
A. 有机磷农药中毒
B. 有机氯农药中毒
C. 亚硝酸盐中毒
D. 含砷杀虫剂中毒
E. 毒蕈中毒

正确答案：A。有机磷农药中毒